某地区发生群体性不明原因疾病时，应急管理措施不正确的是
A. 分工合作，联防联控
B. 及时上报
C. 统一领导，统一响应
D. 信息共享，及时沟通
E. 控制与治疗并重

正确答案：C。统一领导，统一响应

解析：根据应急处理工作原则：统一领导、分级响应（C错，为本题正确答案），及时上报（B对），控制与并重（属于调查与控制的原则，E对），分工合作、联防联控（A对），信息共享、及时沟通（D对）均为在遇到群体性不明原因疾病应急处理工作的原则。